地高辛对心脏的作用不包括
A. 加强心肌收缩力
B. 减慢心率
C. 减慢传导
D. 抑制左心室肥厚
E. 降低自律性

正确答案：D。抑制左心室肥厚